组织和细胞损伤后，周围细胞增殖、修复的过程是
A. 增生
B. 再生
C. 化生
D. 肥大
E. 机化

正确答案：B。再生

解析：组织和细胞损伤后，周围细胞增殖、修复的过程是（病理性）再生（B对）过程。增生（P8）（A错）是指细胞有丝分裂活跃导致组织或器官内细胞数目增多的现象。化生（P9）（C错）是指一种分化成熟的细胞类型被另一种分化成熟的细胞类型所取代的过程。肥大（D错）是指由于功能增加，合成代谢旺盛，使细胞、组织或器官体积增大。机化（E错）是指新生肉芽组织长入并取代坏死组织、血栓、脓液、异物等的过程。